男，47岁。既往慢性乙型肝炎病毒性肝炎病史10余年，1月前出现右上腹隐痛不适。查体：右腹部膨隆，可扪及质地坚硬，表面凹凸不平的肿块，移动性浊音阳性，腹腔积液为血性。最可能的诊断
A. 肝包虫病
B. 原发性肝癌
C. 肝囊肿
D. 肝脓肿
E. 肝血管瘤

正确答案：B。原发性肝癌

解析：中年患者，长期乙肝病史，右上腹隐痛、膨隆有肿块，血性腹腔积液，符合肝癌典型临床表现及体征，最可能的诊断是原发性肝癌（B对）。肝包虫病（A错）（P416）常有牧区居住史或羊、狗等动物密切接触史，肝区可扪及圆形、光滑、弹性强的囊性肿物。肝囊肿（C错）（P421）常无症状，较大的肝囊肿可在腹部触及表面光滑的包块。肝脓肿（D错）常有发热，多数在肋间隙相当于脓肿处有局限性水肿及明显压痛。肝血管瘤（E错）常无症状，腹部包块表面光滑、质地柔软。